盐酸普鲁卡因在溶液中发生的第一步降解反应是
A. 水解
B. 聚合
C. 异构化
D. 氧化
E. 脱羧

正确答案：A。水解

解析：本题考查药物降解途径。盐酸普鲁卡因在溶液中发生的第一步降解反应是水解（A对）。水解是药物降解的主要途径，属于这类降解的药物主要有酯类、酰胺类等。酯类药物的水解：含有酯键的药物在水溶液中或吸收水分后，易发生水解反应，在H⁺或OH⁻或广义酸碱的催化下，反应还可加速。盐酸普鲁卡因的水解可作为这类药物的代表。盐酸普鲁卡因在溶液中反应，第一步水解，盐酸普鲁卡因在酯键处断开，分解成对氨基苯甲酸与二乙氨基乙醇，此分解产物无明显的麻醉作用；第二步：对氨基苯甲酸继续发生氧化（D错），生成有色物质，同时在一定条件下又能发生脱羧（E错）反应，生成有毒的苯胺；第三步：苯胺继续被氧化。聚合（B错）是两个或多个分子结合在一起形成复杂分子的过程。异构化（C错）是改变化合物的结构而不改变其组成和分子量的过程。